男性，63岁。上腹痛2小时，伴恶心、呕吐2次，为胃内容物，在下列疾病诊断中，可能性最小的是
A. 心肌梗死
B. 急性胰腺炎
C. 急性阑尾炎
D. 梅尼埃综合征
E. 急性胃炎

正确答案：D。梅尼埃综合征

解析：心肌梗死（A对）、急性胰腺炎（B对）、急性阑尾炎（C对）、急性胃炎（E对）均可出现上腹痛、恶心呕吐等症状。梅尼埃综合征（D错，为本题正确答案）是一种特发性内耳疾病，典型的梅尼埃病有如下4个症状：眩晕、耳聋、耳鸣及耳内闷胀感，无腹痛，可有恶心呕吐的症状。